高血压病人中，A型行为占
A. 0.436
B. 0.536
C. 0.636
D. 0.736
E. 0.836

正确答案：C。0.636

解析：焦虑情绪反应和心理矛盾的压抑的抑制性敌意是高血压病患者发病主要心理因素。高血压病人中，A型行为占63.6%，对照组占36.4%，有显著差异。掌握“心身疾病”知识点。